男，43岁，长期咳嗽，经常咳脓痰15年，发热、咳脓臭痰1周来诊。查体：左肺下背部呼吸音弱，可闻湿啰音。应考虑诊断可能为
A. 急性肺脓肿
B. 支气管扩张症，继发感染
C. 慢性支气管炎继发感染
D. 支气管囊肿继发感染
E. 左下肺炎

正确答案：B。支气管扩张症，继发感染

解析：中年男性患者，咳嗽、咳脓痰15年（支扩的典型临床表现），近日发热、咳脓臭痰（提示有感染），查体：左肺下背部呼吸音弱，可闻湿啰音（提示左下肺炎），根据患者的病史、临床症状及体征，考虑诊断可能为支气管扩张症，继发感染（B对），支气管扩张症临床表现主要为慢性咳嗽、咯大量脓痰和（或）反复咯血，伴急性感染时，病人可表现为咳嗽、咳脓痰和伴随肺炎。急性肺脓肿（A错）起病急，有高热、咳嗽、大量脓臭痰，该患者起病缓慢。慢性支气管炎（C错）多发生在气候多变的冬、春季节咳嗽、咳痰明显，多咳白色黏液痰，而非脓痰，感染急性发作时可出现脓性痰，但听诊双肺可闻及散在干、湿啰音。该患者现是左下肺炎，但是是由支气管扩张继发感染而来，仅诊断为左下肺炎（E错）并不全面。